某病的流行曲线只有一个高峰，所有病例都集中在该病常见潜伏期这个时间段内，则可断定此暴发为
A. 连续传播性流行
B. 同源暴发
C. 混合型暴发
D. 多次暴露
E. 持续暴露

正确答案：B。同源暴发